新生儿溶血病中，最常见的是
A. RhD溶血病
B. RhE溶血病
C. 其他Rh溶血病
D. ABO溶血病
E. G-6-PD缺乏症

正确答案：D。ABO溶血病

解析：新生儿溶血病系指母子血型不合引起的同族免疫性溶血。当母亲O型胎儿A型或B型时，母亲在首次妊娠前已经受到自然界A或B血型物质的刺激，产生了抗A或抗B的可进入胎盘的IgG抗体，导致新生儿ABO溶血病（D对）。然而当母亲Rh阴性胎儿Rh阳性时，一方面Rh阴性血的人群稀少，另一方面自然界中无Rh血型物质，Rh阴性母亲首次妊娠胎儿可不受母体产生的抗Rh抗体攻击，如该母亲再次妊娠（与第一胎Rh血型相同）时胎儿血进入母血才会引发Rh溶血病，与ABO溶血病比较，发病几率较低（ABC错）。G-6-PD缺乏症（红细胞葡萄糖-6-磷酸脱氢酶缺乏症）是由于调控G-6-PD的基因突变所致，有多种基因变异型，包括伯氨喹啉型药物性溶血性贫血或蚕豆病，感染诱发的溶血，新生儿黄疸等，是由于调控G-6-PD的基因突变所致，呈X连锁不完全显性遗传，并不常见于新生儿溶血（E错）。